伤寒患者第4周后体温恢复正常，症状和体征消失，但1～2周后临床症状再度出现，血培养阳性，应诊断为
A. 心内膜炎
B. 伤寒再燃
C. 伤寒复发
D. 并发中毒性肝炎
E. 并发中毒性心肌炎

正确答案：C。伤寒复发

解析：伤寒患者在退热1～3周后，体温再度升高，临床症状再次出现，血培养阳性，称为伤寒复发（C对）；心内膜炎（A错）热型不规则，会有皮肤苍白，伤寒为稽留热，皮肤出现玫瑰疹；再燃（B错）是指部分患者在缓解期，体温还未下降到正常，即再度升高，持续5～7天后退热，血培养也常阳性，称为再燃；并发中毒性肝炎（D错）多见于病程第1～3周，主要表现为肝肿大；并发中毒性心肌炎（E错）常出现在病程第2～3周。